温里药的主要适应证有
A. 风寒表证
B. 风寒湿痹
C. 中焦寒证
D. 脾肾阳虚
E. 经寒痛经

正确答案：C、D、E。中焦寒证；脾肾阳虚；经寒痛经